《中国药典》规定，广藿香含叶量不得少于
A. 0.2
B. 0.1
C. 0.15
D. 0.25
E. 0.3

正确答案：A。0.2

解析：本题考查的是广藿香的含叶量。《中国药典》规定，广藿香含叶量不得少于20%（A对）。有些药材在采收、加工、炮制、运输过程中，常因其叶在干燥后易脱落或碎裂而致其商品药材中所含叶量少而主要为茎秆，使得药材和饮片总体质量下降。《中国药典》规定穿心莲药材中叶不得少于30%（E错），薄荷药材中叶不得少于30%，广藿香药材中叶不得少于20%等，从而保证这些中药的总体质量。